普查
A. 为了早期发现、早期诊断、早期治疗宫颈癌
B. 为了调查大学生乙型肝炎感染情况，可不必调查所有大学的全部学生
C. 一项在健康人中发现或疑的肺结核患者的调查
D. 对个别发生的麻诊病人进行调查
E. 一次因会餐引起的食物中毒调查

正确答案：A。为了早期发现、早期诊断、早期治疗宫颈癌

解析：本题考查普查的目的。普查的目的主要包括：①早期发现、早期诊断和早期治疗病人，如妇女的宫颈癌普查（A对BCDE错）；②了解慢性病的患病及急性传染性疾病的疫情分布；③了解当地居民健康水平；④了解人体各类生理生化指标的正常值范围。